龋齿一次性充填后，冷热痛，去除刺激后疼痛立即消失，无自发痛，以下哪项一定不是造成患牙冷热痛的原因
A. 充填未垫底
B. 充填体悬突
C. 牙髓状况判断失误
D. 备洞时未用冷水冷却
E. 充填垫底材料选择不当

正确答案：B。充填体悬突

解析：本题考查充填后疼痛。充填体悬突压迫牙龈，出现可定位的自发性疼痛 ，与温度刺激无关（B错，为本题的正确答案）。患牙有冷热痛，去除刺激疼痛立即消失，无自发痛这是典型的可复性牙髓炎症状。若充填未垫底，冷热刺激通过充填体传入牙髓，可引起牙髓刺激性疼痛（A对）。若术中对牙髓状况判断失误，把可复性牙髓炎当做正常牙髓进行治疗，充填后会出现冷热刺激痛（C对）。备洞时未用冷水冷却，机械切割牙体组织产热刺激牙髓，引起牙髓充血，出现激发痛（D对）。充填垫底材料选择不当时，刺激性的垫底材料会激惹牙髓，致牙髓充血，出现激发痛（E对）。